溴隐亭属于
A. 抗胆碱药
B. 多巴胺受体激动剂
C. 复方左旋多巴
D. 单胺氧化酶β抑制剂
E. 儿茶酚-氧-甲基转移酶抑制剂

正确答案：B。多巴胺受体激动剂

解析：溴隐亭为D₂受体强激动剂（B对），小剂量首先激动结节-漏斗通路D₂受体，抑制催乳素和生长激素分泌，用于治疗泌乳闭经综合征和肢端肥大症；增大剂量可激动黒质-纹状体多巴胺通路的D₂受体，与左旋多巴合用治疗帕金森取得较好疗效，能减少症状波动。抗胆碱药（A错）（P135）是苯海索治疗帕金森的作用机制。复方左旋多巴（C错）属于多巴胺前体药。单胺氧化酶β抑制剂（D错）（P133）为司来吉兰治疗帕金森病的机制。儿茶酚-氧-甲基转移酶抑制剂（E错）（P133）是卡巴比妥治疗帕金森病的机制。